属于中枢和外周多巴胺D₂受体阻断剂，具有镇吐、刺激泌乳素释放的促胃肠动力药是
A. 甲氧氯普胺
B. 多潘立酮
C. 莫沙必利
D. 昂丹司琼
E. 阿瑞吡坦

正确答案：A。甲氧氯普胺

解析：本题考查甲氧氯普胺。属于中枢和外周多巴胺D₂受体阻断剂，具有镇吐、刺激泌乳素释放的促胃肠动力药是甲氧氯普胺（A对）；属于外周多巴胺受体阻断剂，直接阻断胃肠道多巴胺D₂受体的促胃肠道动力药是多潘立酮（B错）；属于选择性5-HT₄受体激动剂，促进乙酰胆碱释放的促胃肠动力药是莫沙必利（C错）；昂丹司琼（D错）主要用于由白细胞毒性药物化疗和放射治疗引起的恶心呕吐，也适用于预防和治疗手术后的恶心呕吐；阿瑞吡坦（E错）是神经激肽-1受体阻断剂，通过与NK-1受体结合来阻滞P物质的作用。